下列属于早产儿生理性黄疸特点的是
A. 出生后5～6天出现，30～35天完全消退
B. 出生后3～4天出现，21～28天完全消退
C. 出生后3～4天出现，15～20天完全消退
D. 出生后2～3天出现，10～14天完全消退
E. 出生后1～2天出现，3～7天完全消退

正确答案：B。出生后3～4天出现，21～28天完全消退

解析：新生儿生理性黄疸分为早产儿和足月儿，早产儿黄疸多于生后3～5天出现，5～7天达到高峰，7～9天消退，最长可延迟到3～4周；足月儿黄疸多于生后2～3天出现，4～5天达到高峰，5～7天消退，最迟不超过2周，故出生后3～4天出现，21～28天完全消退是早产儿的生理性黄疸特点（B对）。